临产开始的标志，错误的是
A. 规律宫缩
B. 子宫颈管展平
C. 宫颈口扩张
D. 见红
E. 胎先露部下降

正确答案：D。见红